根据媒介在当地的覆盖情况、受众对媒介的拥有情况和使用习惯来选择媒介属于选择传播媒介的哪项原则
A. 保证效果原则
B. 针对性原则
C. 速度快原则
D. 可及性原则
E. 经济性原则

正确答案：D。可及性原则